胚胎时期卵黄囊管的遗迹
A. Peyer斑
B. Meckel憩室
C. colicbands
D. McBurney点
E. Houston瓣

正确答案：B。Meckel憩室

解析：Meckel憩室(B对)为胚胎时期卵黄囊管未完全消失的遗迹。